肝郁所致阳痿，除阳事不举，或起而不坚，心情抑郁外，还有哪些症状
A. 心烦易怒
B. 口苦咽干
C. 脘闷少食
D. 阴囊潮湿

正确答案：A、C。心烦易怒；脘闷少食

解析：本题考查阳痿之肝郁不舒证的症状。肝郁所致阳痿，除阳事不举，或起而不坚，心情抑郁外，还有哪些症状心烦易怒（A对）、脘闷少食（C对）。阳痿之肝郁不舒证【症状】阳事不兴，或举而不坚；伴心情抑郁，胸胁胀满，善太息。舌苔薄白，脉弦。月经先期之肝郁血热证【症状】月经周期提前，经量或多或少，经色深红或紫红，质稠，经行不畅，或有块；或少腹胀痛，或胸闷胁胀，或乳房胀痛，或心烦易怒，口苦咽干（B错）。舌红，苔薄黄，脉弦数。黄精赞育胶囊【临床应用】肾虚精亏夹湿热型弱精子症、少精子症引起的男性不育。症见腰膝酸软，阴囊潮湿（D错）等，精液检查见精子稀少，活动力差。阳痿之心脾两虚证【症状】阳痿不举；伴心悸，失眠多梦，神疲乏力（E错），面色无华，食少纳呆，腹胀便溏。舌苔薄白，脉细弱。